谷胱甘肽过氧化物酶的组成成分是
A. 乳糖
B. 维生素C
C. 膳食纤维
D. 维生素E
E. 硒

正确答案：E。硒